咳血方的君药是
A. 栀子、蒲黄
B. 大黄、栀子
C. 大黄、柴胡
D. 青黛、栀子
E. 柴胡、当归

正确答案：D。青黛、栀子

解析：咳血方的药物组成为青黛、诃子，瓜蒌仁、海粉、山栀子。方中青黛咸寒，入肝、肺二经，清肝泻火，凉血止血；山栀子苦寒，入心、肝、肺经，清热凉血，泻火除烦，炒黑可入血分而止血，两药合用，澄本清源，共为君药（D对）。火热灼津成痰，痰不清则咳不止，咳不止则血难宁，故用瓜蒌仁甘寒入肺、清热化痰、润肺止咳；海粉（现多用海浮石）清肺降火，软坚化痰，共为臣药。诃子苦涩性平入肺与大肠经，清降敛肺，化痰止咳，用以为佐。诸药合用，共奏清肝宁肺之功，使木不刑金，肺复宣降，痰化咳平，其血自止。